下列哪一项是病例对照研究的优点
A. 是从因到果的研究
B. 适用于罕见病的病因研究
C. 可计算疾病的发病率
D. 不需调查对象的回忆就可获得暴露资料
E. 只能进行一种病因的研究

正确答案：B。适用于罕见病的病因研究